男性患儿，因牙齿剧烈疼痛前来就诊，自述三天前牙齿开始不舒服，随即剧烈疼痛。查：见右上颌的第一乳磨牙穿髓孔大，穿髓孔溢血性分泌物。患儿不敢咬合，根尖部的牙龈有红肿，扪痛。X线片显示患牙根尖处无异常表现。则据此可以诊断
A. 乳牙急性根尖周炎
B. 乳牙慢性根尖周炎
C. 乳牙急性牙髓炎
D. 乳牙慢性牙髓炎
E. 乳牙牙本质敏感

正确答案：A。乳牙急性根尖周炎

解析：急性根尖周炎多是慢性根尖周炎急性发作，可表现为剧烈的自发性疼痛、咀嚼痛和咬合痛，若穿通髓腔，常见穿髓孔溢血或溢脓。患牙松动并有叩痛，根尖部或根分歧部的牙龈红肿，所属淋巴结肿大，并伴有全身发热等症状。掌握“乳牙牙髓病及根尖周病诊断及治疗”知识点。